下列不属于膳食纤维功能的是
A. 增强肠道功能
B. 降低血糖和血胆固醇
C. 控制体重和减肥
D. 预防结肠癌
E. 预防骨质疏松

正确答案：E。预防骨质疏松